下列哪项不是火淫的临床表现
A. 壮热口渴
B. 面红目赤
C. 烦躁不宁
D. 舌质红绛
E. 脉象濡数

正确答案：E。脉象濡数

解析：火淫证中因阳热之气过盛，火热燔灼急迫，气血上涌，且濡脉主虚证或湿困，则脉数有力，而非脉象濡数（E对）。火淫证中因阳热过盛，阳热之邪耗伤津液，故壮热口渴（A错）。火热之邪上炎，故面红目赤（B错）。热扰心神，则烦躁不宁（C错）。火淫证中因阳热之气过盛，火热燔灼急迫，气血上涌，则舌质红绛（D错）。